含有安乃近，代谢产物可进入乳汁，故哺乳期患者不宜使用的中成药是
A. 重感灵片
B. 脉君安片
C. 强力感冒片
D. 藿香正气水
E. 通心络胶囊

正确答案：A。重感灵片

解析：本题考查重感灵片中的西药组分。含有安乃近，代谢产物可进入乳汁，故哺乳期患者不宜使用的中成药是重感灵片（A对）。重感灵片【含西药组分】马来酸氯苯那敏、安乃近。脉君安片（B错）【含西药组分】氢氯噻嗪。强力感冒片（C错）【含西药组分】对乙酰氨基酚。藿香正气水（D错）（乙醇含量40%～50%）、柏子养心丸（片）（朱砂含量3.8%）。《中国药典》收载的妊娠禁用、忌用的主要品种有：二十七味定坤丸、十一味能消丸、通心络胶囊（E错）。